有关胃毗邻的叙述，何者错误
A. 胃前壁的右侧部与肝左叶贴近
B. 介于肝左叶与左肋弓之间的胃前壁直接与腹前壁相贴
C. 胃后壁与左肾左肾上腺横结肠和胰相邻
D. 胃大弯连于大网膜
E. 无

正确答案：D。胃大弯连于大网膜

解析：胃前壁的右侧和肝左叶相邻(A对)，胃前壁的左侧部在肝左叶和左肋弓之间直接与腹前壁相贴(B对)，胃后壁与左肾、左肾上腺、横结肠和胰相邻(C对)，胃大弯通过胃脾韧带与大网膜相连(D错，为本题正确答案)。